细胞膜受体的化学本质是
A. 糖蛋白
B. 脂类
C. 糖类
D. 肽类
E. 核酸

正确答案：A。糖蛋白